与Ⅲ度胎盘早剥症状不相符的是
A. 有妊高征病史
B. 突然剧烈腹痛
C. 阴道流血少
D. 呼吸困难，咳嗽，发绀等呼吸衰竭
E. 子宫成板状，胎心消失

正确答案：D。呼吸困难，咳嗽，发绀等呼吸衰竭

解析：胎盘早剥与下述因素有关：1.孕妇血管疾病如有妊高征病史（A对）2.宫腔内压力骤减如胎膜早破（妊娠足月前）3.机械性因素4.其他高危因素。Ⅱ度胎盘早剥的临床表现：胎盘剥离面1/3左右，突然剧烈腹痛（B对），疼痛的程度及胎盘后积血多少呈正比。无阴道流血或流血量不多，通常阴道出血与休克不成比例（C对），贫血程度与阴道流血量不相符。Ⅲ度胎盘早剥临床表现较Ⅱ度严重，宫缩时可出现子宫呈板状，胎心消失（E对）。呼吸困难，咳嗽，发绀等呼吸衰竭（D错，为本题正确答案）症状是羊水栓塞的临床表现。